标准一致性试验中可靠度优的Kappa值是
A. 0.40以下
B. 0.41～0.60
C. 0.61～0.80
D. 0.81～1.0
E. 1

正确答案：C。0.61～0.80

解析：Kappa值的大小与可靠度的关系。掌握“口腔健康状况调查的样本含量及误差”知识点。